当心脏处于全心舒张期时
A. 心室达到最大充盈
B. 房室瓣关闭
C. 心室容积不变
D. 动脉瓣关闭
E. 心室内压略高于心房内压

正确答案：D。动脉瓣关闭